在口腔健康调查中表示某人群患龋病的频率用
A. 龋均
B. 患龋率
C. 龋齿发病率
D. 菌斑指数
E. 牙龈指数

正确答案：B。患龋率

解析：患龋率指在调查期间某一人群中患龋病的频率，人口基数以百人计算，故常以百分数表示。患龋率主要用于龋病的流行病学研究，如对比和描述龋病的分布，探讨龋病的病因和流行因素等。掌握“龋病流行病学”知识点。